根据《中华人民共和国药品管理法》，对已确认发生严重不良反应的药品，国家或省级药品监督管理部门自鉴定结论作出之日起，依法作出行政处理决定的期限为
A. 5日内
B. 7日内
C. 10日内
D. 15日内
E. 20日内

正确答案：D。15日内

解析：本题考查药品上市后管理。根据《中华人民共和国药品管理法》，对已确认发生严重不良反应的药品，国家或省级药品监督管理部门自鉴定结论作出之日起，依法作出行政处理决定的期限为15日内（D对）。《中华人民共和国药品管理法》第八十一条规定，对已确认发生严重不良反应的药品，由国务院药品监督管理部门或者省、自治区、直辖市人民政府药品监督管理部门根据实际情况采取停止生产、销售、使用等紧急控制措施，并应当在五日内组织鉴定，自鉴定结论作出之日起十五日内依法作出行政处理决定。